下列各项中，以高热、神昏、抽搐为主要辨证依据的是
A. 肝阳化风证
B. 热极生风证
C. 阴虚动风证
D. 血虚生风证
E. 肝阳上亢证

正确答案：B。热极生风证

解析：“热极生风证，临床表现为高热口渴，烦躁谵语或神昏，颈项强直，两目上视，手足抽搐，角弓反张，牙关紧闭，舌质红绛，苔黄燥，脉弦数，本证以高热、神昏、抽搐为辨证的主要依据”，符合题意（B对）。“肝阳化风证，临床表现为眩晕欲仆，步履不稳，头胀头痛，急躁易怒，耳鸣，项强，头摇，肢体震颤，手足麻木，语言謇涩，面赤，舌红，或有苔腻，脉弦细有力。甚至突然昏仆，口眼歪斜，半身不遂，舌强语謇，本证以眩晕、肢麻震颤、头胀痛、面赤，甚至突然昏仆、口眼歪斜、半身不遂等为辨证的主要依据”，不符合题意(A错)。“阴虚动风证，临床表现为手足震颤、蠕动，或肢体抽搐，眩晕耳鸣，口燥咽干，形体消瘦，五心烦热，潮热颧红，舌红少津，脉弦细数，本证以眩晕，手足震颤、蠕动与阴虚内热症状共见为辨证的主要依据”，不符合题意（C错）。“血虚生风证，临床表现为眩晕，肢体震颤、麻木，手足拘急，肌肉目闰动，皮肤瘙痒，爪甲不荣，面白无华，舌质淡白，脉细或弱，本证以眩晕、肢麻、震颤、瘙痒、拘急、目闰动等与血虚症状共见为辨证的主要依据”，不符合题意（D错）。“肝阳上亢证，临床表现为眩晕耳鸣，头目胀痛，面红目赤，急躁易怒，失眠多梦，头重脚轻，腰膝酸软，舌红少津，脉弦有力或弦细数，本证以眩晕耳鸣、头目胀痛、面红、烦躁、腰膝酸软等为辨证的主要依据”，不符合题意（E错）。